女性，52岁，右肩部疼痛进行性加重1年，冬春季重，夏秋季轻，活动障碍以外展、上举、旋转较重，关节无红肿、热等征象。应首先考虑的诊断是
A. 肩关节脱位
B. 肩关节骨折
C. 肩关节肿瘤
D. 肩关节周围炎
E. 肩关节慢性感染

正确答案：D。肩关节周围炎

解析：女性患者，52岁，右肩部疼痛进行性加重1年，冬春季重，夏秋季轻，活动障碍以外展、上举、旋转较重，关节无红肿、热等征象。综合患者的症状、体征，应首先考虑的诊断是肩关节周围炎（D对）。肩关节脱位（A错）有上肢外展外旋或后伸着地受伤历史，病人有以健手托住病侧前臂、头向病侧倾斜的特殊姿势，检查可发现患肩呈方肩畸形。肩关节骨折（B错）多有受伤史，X线片检查可确诊，无进行性加重与季节分布的特点。肩关节肿瘤（C错）可因肿瘤压迫出现功能受限，部分病人伴肩臂及手指麻痛的症状，无季节分布的特点。肩关节慢性感染（E错）多有红肿热痛的局部炎症表现。